舌质与舌苔异常，可以反映病情的变化。下列关于舌质、舌苔主病的说法，错误的是
A. 舌光无苔，胃阴大伤
B. 苔白积粉，气虚有湿
C. 苔灰干燥，阴虚火旺
D. 舌苔黄腻，食积内停
E. 舌苔腐腻，痰浊邪盛

正确答案：B。苔白积粉，气虚有湿

解析：本题考查的是望舌苔的主要内容及临床意义。苔白积粉为毒热内盛所致（B错，为本题正确答案）。望舌苔的主要内容及临床意义：舌苔是胃气上蒸而生。正常人仅有一层薄白苔，干湿适中，不滑不燥，是胃气正常的表现。病苔是胃气挟邪气上蒸而成。观察舌苔的异常变化，有助于对疾病的诊断。望舌苔，包括望苔色及苔质两个内容。（1）望苔色：望苔色，以观察苔色的变化来推断疾病的性质。苔色主要有白、黄、灰、黑四种，苔色与病邪性质有关。①白苔：一般常见于表证、寒证。薄白苔，本是正常的舌苔。感受外邪，病犹在表，尚未传里的时候，舌苔往往不起明显变化，而仍见薄白苔。故苔薄白，在临证时可作为病邪在表而未入里的佐证。舌淡苔白，常见于里寒证。若舌上满布白苔，有如白粉堆积在舌上，扪之不燥，为积粉苔，由于外感秽浊不正之气，毒热内盛所致，常见于瘟疫，亦见于内痈。②黄苔：主热证、里证。黄苔，为热邪熏灼所致，故主热证。一般来讲，苔色越黄，反映热邪越重，淡黄为热轻，深黄为热重，焦黄为热结。黄苔又主里证，故外感病苔由白转黄者，为表邪入里化热的征象。由于黄苔主热主里，因此黄苔又常与红绛舌并见。若舌淡胖嫩而见苔黄滑润者，则应考虑阳虚水湿不化。③灰苔：主里证，可见于里热证，亦可见于寒湿证。灰色即浅黑色，常可发展为黑苔，故灰黑苔常同时并见。灰苔可由白苔转化而来，也可与黄苔同时并见。若苔灰而润，则多为寒湿内阻，或痰饮内停；而苔灰干燥，则多属热炽津伤，或阴虚火旺（C对）。④黑苔：主里证，主热极又主寒盛。黑苔多由灰苔或焦黄苔发展而来，常见于疾病的严重阶段。若苔黑而燥裂，甚则生芒刺，多为热极津枯；苔黑而润滑，则多属阳虚寒盛。可见灰黑苔辨寒热，看苔之干燥与润滑有重要意义。（2）望苔质：望苔质，主要是观察舌苔的厚薄、润燥、腻腐、剥脱、有根无根等来推断疾病的变化。①厚薄：苔质的厚薄，以“见底”和“不见底”为标准，也就是透过苔能隐隐见到舌体的为薄苔，不能见到舌体的为厚苔。观察舌苔的厚薄，能帮助了解病邪的轻重及病情的进退。一般来说，疾病初起、病邪在表、病情较轻者，舌苔多薄；而病邪传里、病情较重，或内有食饮痰湿积滞者，则舌苔多厚。舌苔由薄增厚，表示病邪由表入里，病情由轻转重，为病进；而由厚变薄，则表示邪气得以内消外达，病情由重变轻，多属病退。②润燥：正常舌苔是润泽的，为津液上承之征。察舌苔的润燥，主要是了解津液变化的情况。苔面干燥，望之枯涸，扪之无津，称为燥苔；更甚者有粗糙刺手感觉的又称糙苔，是津液不能上承所致，多见于热盛津伤或阴液亏耗的病证。但也有因阳气虚不能化津上润而苔反燥者。苔面有过多水分、扪之滑利而湿，称为滑苔，多是水湿内停之征。舌苔由燥转润，往往是热邪渐退或津液渐复之象，表示病情好转，若由润变燥，则表明津液已伤，热势加重，或邪从热化。③腻腐：腻苔，是舌面上覆盖着一层浊而滑腻的苔垢，颗粒细腻而致密，刮之难去，多见于湿浊、痰饮、食积（D对）等阳气被阴邪所抑的病变，如痰饮、湿温等病证。腐苔，苔质颗粒较大，松软而厚，形如豆腐渣堆积舌面，刮之易脱，多由阳热有余、蒸腾胃中腐浊邪气上升而成，常见于食积、痰浊等病（E对）。④剥落：苔的有无与消长变化，是正邪斗争互为消长的表现。若舌苔骤然退去，不再复生，以致舌面光洁如镜（A对），即为光剥舌，又叫“镜面舌”，是胃阴枯竭、胃气大伤的表现。若舌苔剥落不全，剥脱处光滑无苔，称为“花剥苔”，也属胃的气阴两伤之候。若花剥而兼有腻苔者，说明痰浊未化、正气已伤，病情较为复杂。⑤有根与无根：舌苔坚敛而着实，紧贴着舌面，刮之难去，舌与苔如同一体，苔像从舌里长出来的，即为有根苔，又称真苔；而舌苔不着实，似浮涂在舌上，刮之即去，不像是从舌上生出来的，则为无根苔，又称假苔。察舌苔之有根、无根，对辨邪正虚实、胃气的有无有重要意义。一般地说，有根的多为实证、热证，表示有胃气，无根的则多见于虚证、寒证，表示胃气衰。